治疗糖尿病患者便秘，慎用的泻药是
A. 吗啡
B. 木糖醇
C. 乳酶生
D. 硫酸镁
E. 乳果糖

正确答案：E。乳果糖

解析：本题考查药物的禁忌症。治疗糖尿病患者便秘，慎用的泻药是乳果糖（E对）。乳果糖用于肝昏迷或昏迷前期的治疗剂量较高，糖尿病患者应慎用。半乳糖血症患者禁用或慎用。镇痛药如吗啡（A错）能降低排便反射刺激的敏感性。木糖醇（B错）是糖尿病人安全的甜味剂、营养补充剂和辅助治疗剂。乳酶生（C错）为活肠球菌的干燥制剂，在肠内分解糖类生成乳酸，使肠内酸度增高，从而抑制腐败菌的生长繁殖，并防止肠内发酵，减少产气，因而有促进消化和止泻作用，适用于治疗消化不良，肠内异常发酵，小儿腹泻及小儿绿便等。老年人应慎用硫酸镁（D错），年老体弱多病的慢性便秘者需长期规律应用泻药，最好不要间断，以维持正常排便，预防粪便嵌塞。